下列哪项引起静脉回心血量减少
A. 体循环平均充盈压增大
B. 心脏收缩力量增强
C. 平卧体位
D. 骨骼肌节律舒缩
E. 呼气运动

正确答案：E。呼气运动